常用于空胶囊壳中的遮光剂是
A. 二氧化硅
B. 二氧化钛
C. 二氯甲烷
D. 聚乙二醇400
E. 聚乙烯吡咯烷酮

正确答案：B。二氧化钛